我国艾滋病流行呈现全国低流行、局部高流行的特点。在艾滋病感染率相对较高的地区，为了预防HIV的母婴垂直传播，某机构计划在该地区育龄妇女中开展预防和控制艾滋病的健康教育活动，为HIV感染妇女提供相关的防治信息。下列防治信息不正确的是
A. HIV感染妇女提倡母乳哏养
B. HIV感染妇女要使用高质量安全套
C. HIV感染妇女要在孕期使用抗病毒药物
D. HIV感染妇女要在产后使用抗病毒药物
E. HIV感染妇女所生婴儿出生后要使用抗病毒药物

正确答案：A。HIV感染妇女提倡母乳哏养